氟的防龋机制不包括
A. 降低釉质溶解性
B. 增加釉质厚度
C. 促进再矿化
D. 抑制细菌酶
E. 影响牙外形

正确答案：B。增加釉质厚度

解析：本题考查氟的防龋机制。氟的防龋机制不包括增加釉质厚度（B错，为本题正确答案）。氟化物的防龋机制可归结为抑制牙釉质的脱矿和促进早期脱矿区域的再矿化（C对）作用。牙釉质的溶解性降低（A对）和局部pH升高，抑制细菌酶（D对），终止和预防了龋病的发生，而再矿化过程可使牙釉质早期脱矿的区域得到修复，影响牙外形（E对）。